某人中午食用大量木薯后，晚饭时出现口中苦涩，流涎、头晕、恶心、呕吐、四肢无力等症状。其中毒机制为
A. 凝集人红细胞中的蛋白质
B. 阻断组织对氧的利用
C. 破坏细胞膜结构
D. 增加体内自由基
E. 抑制人体内蛋白酶

正确答案：B。阻断组织对氧的利用